为研究A、B两种试剂盒测量人体血液中氧化低密度脂蛋白含量（mmol/L）的差异，分别用两种试剂盒测量同一批检品（200例），假设检验方法应选用
A. 成组t检验
B. 成组u检验
C. 两样本χ²检验
D. 配对t检验
E. 配对χ²检验

正确答案：D。配对t检验